原发性疱疹性口炎的病因是感染了
A. HSVI
B. HSVⅡ
C. HIVI
D. HIVⅡ
E. 以上都不对

正确答案：A。HSVI

解析：本题考查原发性疱疹性口炎的病因。原发性疱疹性口炎常见由Ⅰ型单纯性疱疹病毒（A对）引起的口腔病损，可能表现为一种较严重的龈口炎-急性疱疹性龈口炎。Ⅰ型单纯疱疹病毒主要引起口腔黏膜、咽、口周皮肤、面部、腰以上皮肤黏膜及脑的感染；Ⅱ型单纯疱疹病毒主要引起腰以下皮肤黏膜及生殖器的感染（B错）。HIV感染引起艾滋病（CD错）。